30名头痛患者按照病情分为10个区组，每一区组内3名患者随机接受标准方法或两种新方法治疗，得到其各自的止痛时间。欲研究新方法与标准的止痛时间是否相同，下列说法正确的是
A. 选用完全随机设计资料的方差分析
B. 选用随机区组设计资料的方差分析
C. 用t检验对任意两均数进行比较
D. 选用成组t检验
E. 选用配对t检验

正确答案：B。选用随机区组设计资料的方差分析